心位于胸腔内与周围器官密切相关，是血液循环的核心器官。右心房结构描述中正确的是
A. 分为前方的固有心房和后方的右心耳
B. 心耳突向前上方，内有肉柱
C. 前、后部表面以界沟分隔，腔内以界嵴分隔
D. 卵圆窝位于右心房的后壁
E. 腔静脉窦上、下方分别有上、下腔静脉口及其瓣膜

正确答案：C。前、后部表面以界沟分隔，腔内以界嵴分隔

解析：右心房分为前方的固有心房和后方的腔静脉窦（A错）。右心室内有肉柱（B错）。右心房前、后部表面以界沟分隔，腔内以界嵴分隔（C对）。卵圆窝位于右心房的内侧壁（D错）。腔静脉窦上、下方分别有上、下腔静脉口，下腔静脉口才有静脉瓣（E错）。